归经的理论基础有
A. 药物疗效
B. 脏象学说
C. 阴阳学说
D. 经络学说
E. 药物特性

正确答案：B、D。脏象学说；经络学说

解析：本题考查归经的理论基础。归经的理论基础有脏象学说（B对）、经络学说（D对）。归经：归，即归属，指药物作用的归属；经，即人体的脏腑经络。归经，即药物作用的定位。就是把药物的作用与人体的脏腑经络密切联系起来，以说明药物作用对机体某部分的选择性，从而为临床辨证用药提供依据。归经理论基础：1.藏象学说2.经络学说。归经确定依据：1.药物特性（E错）2.药物疗效（A错）。归经表述方法：一般采用十二脏腑经络法表述，或不提脏腑之名而用经络的阴阳属性（C错）表述。